应当保证其提供的商品或者服务的实际质量与其表明的（如产品说明、实物样品等）质量状况相符，是属于
A. 经营者的义务
B. 消费者的义务
C. 生产者的义务
D. 消费者协会的职能
E. 行业协会的职能

正确答案：A。经营者的义务

解析：本题考查经营者的义务。应当保证其提供的商品或者服务的实际质量与其表明的（如产品说明、实物样品等）质量状况相符，是属于经营者的义务（A对）。经营者有向消费者提供信息的义务。经营者向消费者提供有关商品或者服务的质量、性能、用途、有效期限等信息，应当真实、全面，不得作虚假或者引人误解的宣传。经营者对消费者就其提供的商品或者服务的质量和使用方法等问题提出的询问，应当作出真实、明确的答复。经营者提供商品或者服务应当明码标价。行业协会的职能（E错）包括：组织职能、协调职能、服务职能、监管职能。